一位体重60Kg的女患者，因外伤引起急性出血约2000ml，经手术止血并在应用晶体液和人造胶体液补足血容量（血压已稳定）的基础上，宜输注下列何种血制品
A. 红细胞悬液（添加剂红细胞）
B. 保存全血
C. 洗涤红细胞
D. 新鲜冰冻血浆
E. 新鲜全血

正确答案：A。红细胞悬液（添加剂红细胞）

解析：大量失血时除有明显血容量不足、血压不稳定外，还可出现血细胞比容下降。该患者已应用晶体液和胶体液补足血容量、血压稳定，此时还宜输注红细胞悬液（A对）以增加血细胞比容，提高机体携氧能力。而不宜输注全血（BE错），一方面全血成分较多，易引发过敏或溶血反应；另一方面，若在补充血容量的基础上输注全血易发循环超负荷。洗涤红细胞（C错）是指去除了绝大多数血浆、白细胞、血小板及肝炎病毒、抗A、B抗体的红细胞溶液，其成本较高，主要用于多次输血后出现发热反应或不能耐受高血钾者。新鲜冰冻血浆主要应用于补充凝血因子（D错）。